下列哪一项与心身疾病的诊断无关
A. 器质性病变的临床特点
B. 有明确的心理社会因素参与发病
C. 排除神经症和精神病
D. 单纯生物医学措施疗效甚微
E. 由某种躯体疾病引发心理障碍

正确答案：E。由某种躯体疾病引发心理障碍